血清淀粉酶水平是临床上诊断和监测急性胰腺炎的重要指标，其升高一般出现在发病后
A. 72小时
B. 48小时
C. 2-12小时
D. 24小时
E. 10小时

正确答案：C。2-12小时

解析：急性胰腺炎时血清淀粉酶的升高一般出现在发病后2-12小时（C对），48小时开始下降，持续3-5天。